初期复苏的任务和步骤可归纳为
A. 充分供氧一进行人工呼吸一建立人工循环
B. 建立人工循环—保持呼吸通畅—进行人工呼吸
C. 保持呼吸道通畅一进行人工循环一进行人工呼吸
D. 心脏复苏一兴奋呼吸中枢一脑复苏
E. 头部降温一脱水一皮质激素治疗

正确答案：B。建立人工循环—保持呼吸通畅—进行人工呼吸

解析：心肺复苏中A（airway）指及时开放气道，保持呼吸顺畅；B（Breath）指及时进行人工呼吸；C（circulation）指实施人工血压循环，即及时实施胸外心脏按压。按传统观点，初期复苏的任务和步骤可归纳为保持呼吸道通畅→进行人工呼吸→建立人工循环（B对），即A-B-C。需注意：2010年AHA复苏指南已将成人心肺复苏的顺序由A-B-C改为CBA，建立人工循环—保持呼吸通畅—建立人工呼吸。